男，50岁。出现冻结肩，活动受限，以下处理错误的是哪项
A. 理疗
B. 肩关节固定
C. 热敷
D. 消炎
E. 锻炼

正确答案：B。肩关节固定

解析：患者男，50岁。出现冻结肩，活动受限，结合患者的表现，提示为粘连性肩关节囊炎，应给予理疗、针炎、适度的推拿按摩、非甾体抗炎药抗炎药、锻炼等治疗，肩关节固定不属于其治疗方法(B错，为本题的正确答案)。